治疗月经后期的刺灸方法是
A. 关元加隔姜灸
B. 三阴交毫针泻法
C. 血海毫针泻法
D. 三阴交加拔罐
E. 血海加拔罐

正确答案：A。关元加隔姜灸

解析：月经后期是月经周期推迟7日以上甚至2～3月一潮。治应益气和血，调畅冲任。以气海、三阴交、归来为主穴，治疗应用毫针补法，可加灸，寒凝配关元（A对）、命门；血虚配足三里、血海。